急性龋的临床表现为
A. 多见于中、老年人
B. 病变进展较平稳
C. 龋洞内腐质湿软
D. 龋坏牙本质着色深
E. 进展与全身情况无关

正确答案：C。龋洞内腐质湿软

解析：急性龋：①多见于儿童或青年人；②病变进行较快，数月内即可形成龋洞；③洞内病变组织颜色较浅，呈浅棕色；④质地较软而且湿润，很容易用挖器剔除；⑤进展受全身情况影响。掌握“龋病的临床表现与分类”知识点。